可引起牙龈增生的药物是
A. 硝苯吡啶
B. 甲硝唑
C. 螺旋霉素
D. 二甲胺四环素
E. 青霉素

正确答案：A。硝苯吡啶

解析：本题考查药物性牙龈肥大的病因。可引起牙龈增生的药物是硝苯吡啶（A对）。药物增生性牙龈炎是指长期服用某些药物而引起的牙龈纤维性增大和体积增大。与药物增生性牙龈炎有关的三类常用药物有：①抗癫痫药物—苯妥英钠；②免疫抑制剂—环孢素；③钙通道阻断剂—硝苯地平、维拉帕米。硝苯地平（心痛定）对高血压、冠心病患者具有扩张周围血管和冠状动脉的作用，硝苯吡啶本品为钙拮抗剂，钙通道阻断剂是常用的降压药。